人居环境可划分为以下哪几大系统
A. 自然系统、人类系统、社会系统、居住系统
B. 人类系统、居住系统、自然系统、社会系统、支撑系统
C. 自然系统、人类系统、社会系统、支撑系统
D. 自然系统、人类系统、支撑系统、居住系统
E. 社会系统、自然系统、人类系统、居住系统、公共系统

正确答案：B。人类系统、居住系统、自然系统、社会系统、支撑系统

解析：本题考查人居环境的划分系统。人居环境可划分为五大系统：1.人类系统：指人在人居环境中与自然环境相联系，开展社会活动；人居环境由人类创建，又对人类产生影响；2.居住系统：指住宅、社区设施（如办公场所）、城市中心（如公共场所）等；3.自然系统：指气候、水土、动植物种类、地理资源等，是聚居产生并发挥功能的基础；4.社会系统：指公共管理和法律、社会关系、人口趋势、文化特征、经济发展、卫生服务和政策等；5.支撑系统（B对ACDE错）：为人类活动提供支持的、服务于聚落并将聚落联为整体的所有人工和自然的联系系统、技术支持保障系统，如公共服务设施、交通通讯系统、物质环境规划等。